女，28岁哺乳期间左侧乳房胀痛、发热3天，查体：T39.2℃，P106次/分，左乳房外上象限6/4cm红肿，有明显压痛，无波动感，应该采用的药物是
A. 红霉素
B. 庆大霉素
C. 青霉素
D. 左氧氟沙星
E. 万古霉素

正确答案：C。青霉素

解析：女，28岁哺乳期间左侧乳房胀痛（乳腺炎多发人群）、发热3天，查体：T39.2℃，P106次/分，左乳房外上象限6/4cm红肿，有明显压痛，无波动感（乳房疼痛、局部红肿、发热为乳腺炎的常见临床表现），考虑诊断为急性乳腺炎。早期呈蜂窝织炎表现而未形成脓肿之前，应用抗生素可获得良好的效果。因主要病原菌为金黄色葡萄球菌，可不必等待细菌培养的结果，应用青霉素治疗（C对）。